免疫缺陷最主要的临床特征是
A. 易发生恶性肿瘤
B. 易伴自身免疫病
C. 多系统受累且症状多样
D. 易患感染
E. 原发性免疫缺陷多为基因缺陷所致

正确答案：D。易患感染

解析：免疫缺陷患者易患感染性疾病。B细胞、吞噬细胞或补体缺陷者易患化脓性细菌感染；细胞免疫缺陷者主要易患由病毒、真菌、胞内寄生菌和原虫引起的感染。掌握“免疫缺陷概述及原发性、获得性免疫缺陷病”知识点。